急性肾小球肾炎症见肢体浮肿，呛咳，气急，心悸，胸闷，口唇青紫，舌苔白腻，脉细数无力。其证型是
A. 风水相搏
B. 毒浸淫
C. 水凌心肺
D. 邪陷心肝
E. 水毒内闭

正确答案：C。水凌心肺

解析：急性肾小球肾炎症见肢体浮肿，为水湿内停之象；呛咳，气急，为水湿射肺之征；心悸，胸闷，为水饮凌心的表现；综合以上辨证为水凌心肺（C对）。风水相搏证，主要症状有恶寒发热，咳嗽气短，面部浮肿，或全身水肿，皮色光泽等（A错）。毒浸淫证，主要表现为皮肤疮毒未愈，面部或全身水肿，口干口苦，尿少色赤，甚则血尿（B错）。急性肾小球肾炎病位主要在脾肾两脏，一般没有邪陷心肝的证型，另一方便邪陷心肝主要表现为心烦，失眠，口苦，烦躁等表现（D错）。水毒内闭主要表现为全身浮肿，尿少，恶心呕吐，口中气秽，头晕头痛，嗜睡（E错）。